男，71岁。血清PSA异常增高，对明确诊断最有帮助的检查是
A. 放射性核素显像
B. 腹部B超
C. MRI
D. CT
E. KUB

正确答案：C。MRI

解析：PSA为前列腺特异性抗原，为前列腺癌的特异性检查。MRI（C对）在诊断前列腺癌方面有着较高的敏感性和特异性，并可对肿瘤局部侵犯程度及有无盆腔淋巴结转移做出初步评估。放射性核素显像（A错）主要用于确定分肾功能。腹部B超（B错）对于早期前列腺癌病人常无异常发现。CT（D错）有助于鉴别不透光的结石、肿瘤、血凝块等，以及了解有无肾畸形。KUB（E错）即腹部泌尿系平片（肾-输尿管-膀胱摄影）不能明确诊断。